致畸作用的敏感期是
A. 着床前期
B. 着床期
C. 器官形成期
D. 器官形成后期
E. 胎儿期

正确答案：C。器官形成期

解析：本题考查致畸作用的敏感期。化学物在孕期特别是胎儿器官形成期（C对ABDE错）对胚胎发育和结构畸形的发生有重要影响。